清热燥湿药的性味多为
A. 苦、寒
B. 甘、寒
C. 辛、苦、温
D. 甘、苦、温
E. 甘、辛、温

正确答案：A。苦、寒

解析：该题考查的是清热燥湿药的性味，属记忆内容。清热燥湿药，本类药物性味苦寒，清热之中，燥湿力强（A对）。